患者，男，70岁。神志痴呆，表情淡漠，举止失常，面色晦滞，胸闷泛恶，舌苔白腻，脉滑。其病机是
A. 痰迷心窍
B. 痰火扰心
C. 心血瘀阻
D. 肾精亏虚
E. 心脾两虚

正确答案：A。痰迷心窍

解析：痰蒙心神，又称痰迷心窍，是痰浊蒙闭心窍表现的证候。神志痴呆，表情淡漠，举止失常，均多因情志不遂，肝失疏泄，气郁痰生，痰气互结，蒙蔽神明，不能自主所致；面色晦滞多因痰浊内阻，清阳不升，浊气上泛，气血不畅所致；胸闷泛恶多因痰阻胸阳，胃失和降所致；舌苔白腻，脉滑，均多因痰浊内盛所致。故为痰迷心窍（A对）。痰火扰心，外感病以高热、痰盛、神昏为辨证要点；内伤病以心烦失眠、神志狂乱、苔腻脉滑为辨证要点。非上述症状（B错）。心血瘀阻以心悸怔忡，心胸憋闷疼痛与瘀血症状共见为辨证要点，非上述症状（C错）。肾精亏虚以生长发育迟缓、早衰、生育机能低下等为辨证要点，非上述症状（D错）。心脾两虚以心悸、神疲、头晕、食少、腹胀、便溏等为辨证要点，非上述症状（E错）。